妊娠期间孕妇循环系统的变化正确的是
A. 妊娠晚期舒张压一般偏高
B. 心排出量自妊娠20周逐渐增加
C. 心脏容量至妊娠末期约增加25%
D. 心排出量至妊娠32～34周达高峰
E. 妊娠晚期心率休息时每分钟增加5次

正确答案：D。心排出量至妊娠32～34周达高峰